男，72岁。10年前因急性心肌梗死住院。5年前出现活动后气短，夜间憋醒。近1年双下肢水肿、少尿。查体：BP140/90mmHg，颈静脉怒张，双下肺可闻及细湿啰音。心界向两侧扩大，心率110次/分，肝肋下3cm，质中，压痛（+），双下肢水肿。该患者最可能的诊断为
A. 左心衰竭
B. 右心衰竭
C. 心功能Ⅲ级（Killip分级）
D. 心功能Ⅲ级（NYHA分级）
E. 全心衰竭

正确答案：E。全心衰竭

解析：患者有双肺湿罗音，说明有急性左心衰竭。患者有颈静脉怒张、肝肿大、双下肢水肿，说明有右心衰竭。故目前患者应诊断为全心衰竭。掌握“心力衰竭”知识点。